釉基质正常形成并开始矿化，但釉质晶体结构出现成熟障碍属于以下哪种分类的基本表现
A. 釉质形成不全
B. 釉质成熟不全
C. 釉质钙化不全
D. 遗传性乳光牙本质
E. 畸形中央尖

正确答案：B。釉质成熟不全

解析：釉质成熟不全型，釉基质正常形成并开始矿化，但釉质晶体结构出现成熟障碍。病变牙形态正常，但出现斑块状的白、黄、棕色变色不透光区，釉质较正常软，易磨耗，但不如钙化不全型者严重。掌握“釉质形成缺陷（釉质发育不全）”知识点。